关于鸟氨酸循环的叙述，正确的是
A. 鸟氨酸循环直接从鸟氨酸与氨结合生成瓜氨酸开始
B. 鸟氨酸循环从氨基甲酰磷酸合成开始
C. 每经历1次鸟氨酸循环消耗1分子氨
D. 每经历1次鸟氨酸循环消耗2分子ATP
E. 鸟氨酸循环主要在肝内进行

正确答案：E。鸟氨酸循环主要在肝内进行